下列关于有效期的描述，正确的有
A. 药品的有效期就是药品的保险期
B. 有效期内药品也可降效或变质
C. 同一种药品采用不同钓包装容器，有效期可以不同
D. 药品离开原包装时应将有效期注明在更换后的容器上
E. 药品离开原包装时若在短期间使用，可不注明有效期

正确答案：B、C、D。有效期内药品也可降效或变质；同一种药品采用不同钓包装容器，有效期可以不同；药品离开原包装时应将有效期注明在更换后的容器上